患儿，男，8岁。感冒后咳嗽日久不愈，咳声阵发，发则连声不绝，终止时有鸡啼样回声，此为
A. 短气
B. 顿咳
C. 喘
D. 哮
E. 白喉

正确答案：B。顿咳

解析：患儿咳嗽日久不愈，咳声阵发，发则连声不绝，终止时有鸡啼样回声，符合顿咳的辨证要点（B对）。短气是指呼吸气急短促，气短不足以息，数而不相接续似喘而不抬肩，喉中无痰鸣音（A错）。喘是指呼吸困难、短促急迫，甚至张口抬肩，鼻冀扇动，难以平卧（C错）。哮是指呼吸急促似喘，喉间有哮鸣音，常反复发作，缠绵难愈（D错）。咳声如犬吠，伴有声音嘶哑，吸气困难，喉中有白膜生长，擦破流血，随之复生，是时行疫毒攻喉所致，多见于白喉（E错）。